常用菌斑显示剂有
A. 品红溶液
B. 龙胆紫液
C. 碘化油
D. 亚甲基蓝
E. 荧光素钠

正确答案：A。品红溶液

解析：本题考查常用的菌斑显示剂。品红溶液（A对）是常用菌斑显示剂，将品红溶液涂布于全口牙的颊舌面及邻间隙处，漱口后，牙面上的菌斑即可着色。菌斑记录的百分率若达到小于20%，则表明菌斑基本被控制。龙胆紫液（B错）用于涂抹治疗某些口腔黏膜病、检查隐裂牙和口腔修复中作为义齿基托组织面缓冲显示剂。碘化油（C错）是牙周洁治术后涂布于牙周袋处的消炎收敛药物。亚甲基蓝（D错）是组织病理切片显示剂。荧光素钠（E错）也是一种菌斑显示剂，应用有局限性，在特殊的蓝色光源下，菌斑显出黄色，在日光下不显示颜色，所以不如品红溶液常用。